脑出血患者，应用甘露醇3天后出现少尿，尿钠40mmol/L，其肾衰竭原因应是
A. 急性间质性肾炎
B. 肾后性急性肾衰竭
C. 肾前性氮质血症
D. 急性肾小管坏死
E. 急进性肾小球肾炎

正确答案：D。急性肾小管坏死

解析：脑出血患者，应用甘露醇3天后出现少尿（<400ml/日），尿钠40mmol/L（肾前性AKI<20mmol/L；急性肾小管坏死>20mmol/L），故其肾衰竭原因应是急性肾小管坏死（D对C错）。因急性脑出血发病后脑体积增大，重量增加，发生脑水肿，或脑脊液增多，导致颅内压升高，应用甘露醇目的是进行组织脱水降低颅内压，但甘露醇的副作用是损伤肾小管，容易引起急性肾小管坏死。急性肾小管坏死时，肾小管对钠的吸收减少，常呈急性少尿，一次性尿钠>40mmol/L。急性间质性肾炎（A错）、急进性肾小球肾炎（E错）都属于肾性AKI，题干中并未提到肾间质、肾小球性疾病导致的损伤。肾后性急性肾衰竭（B错）源于急性尿路梗阻，题干并未提到有引起尿路梗阻的因素。